可摘局部义齿人工后牙减径的目的是
A. 减轻（牙合）力
B. 获得咬合平衡
C. 提高咀嚼效率
D. 利于发音
E. 增强固位

正确答案：A。减轻（牙合）力

解析：本题考查局部义齿的设计。人工牙减径，减数，制取压力印模，扩大基托伸展面积等均可以分散（牙合）力（A对）。人工后牙减径减少了咬合面积。